在tRNA的一个分子中大约含有多少个稀有碱基
A. 3～5个
B. 5～7个
C. 7～10个
D. 7～15个
E. 10～15个

正确答案：D。7～15个

解析：tRNA含有很多稀有碱基，每个分子中有7～15个稀有碱基，其中有些是修饰碱基，是在转录后经酶促修饰形成的。在修饰碱基中，甲基化的A、U、C和G较多。甲基化可防止碱基对的形成，从而使这些碱基易与其他分子反应。甲基化也使tRNA分子有部分疏水性，在与氨基酰tRNA合成酶及核糖体反应时比较重要。掌握“RNA”知识点。